热邪壅肺证，可见
A. 咳嗽，咳痰稀白
B. 咳嗽，痰多泡沫
C. 咳喘，咳痰黄稠
D. 咳嗽，痰少难咳
E. 咳喘，痰多易咳

正确答案：C。咳喘，咳痰黄稠

解析：邪热炽盛，内壅肺脏，肺气上逆而为咳嗽；炼液为痰，则痰稠色黄（C对）。咳嗽，咳痰稀白见于寒邪客肺，感受寒邪，内客于肺，阳气被郁，肺气上逆则为咳嗽；寒为阴邪，所以咳痰稀白（A错）。咳嗽，痰多泡沫多为肝经风痰，肺虚所致（B错）。咳嗽，痰少难咳多为燥邪犯肺，肺津耗损，肺失滋润，清肃失职所致（D错）。咳嗽，痰多易咯见于痰湿阻肺，由湿痰阻肺，肺气上逆所致（E错）。